某女，50岁。因痰热壅肺导致咳嗽痰多、色黄黏稠、胸闷口干。治当清肺、化痰、止咳，宜选用的成药是
A. 橘贝半夏颗粒
B. 人参保肺丸
C. 七味都气丸
D. 二陈丸
E. 橘红丸

正确答案：E。橘红丸

解析：本题考查的是橘红丸的功能。治当清肺、化痰、止咳，宜选用的成药是，宜选用的成药是橘红丸（E对）。橘红丸【功能】清肺，化痰，止咳。橘贝半夏颗粒（A错）【功能】化痰止咳，宽中下气。人参保肺丸（B错）【功能】益气补肺，止嗽定喘。七味都气丸（C错）【功能】补肾纳气，涩精止遗。二陈丸（D错）【功能】燥湿化痰，理气和胃。